患儿，1岁。发热流涕，鼻塞咳嗽半天，突然两目凝视，继而四肢抽搐，经针刺后搐止。用汤剂治疗时，还应加
A. 紫雪丹
B. 至宝丹
C. 苏合香丸
D. 小儿回春丹
E. 安宫牛黄丸

正确答案：D。小儿回春丹

解析：患儿发热流涕，鼻塞咳嗽后突然两目凝视，继而四肢抽搐，此乃急惊风，证属风热动风，其一般先见风热表证，很快发作抽风，应疏风清热，息风定惊，可内服方药银翘散加减，其抽搐严重可加中成药小儿回春丹（D对）。紫雪丹适于温热病、热邪内陷心包，且引动肝风所致的神昏症（A错）。至宝丹适于痰热内闭心包证所致的神昏证（B错）。苏合香丸适于寒闭证（C错）。安宫牛黄丸适于邪陷心肝的急惊风（E错）。